男性，48岁。体检发现右肾下有2cm×2cm占位病变，IVU尿路造影未见右肾盂肾盏形态改变，CT可诊断右肾下极恶性肿瘤，左肾形态和功能正常，下面治疗方案哪项是正确的
A. 根治性右肾切除
B. 右肾切除
C. 右肾部分切除
D. 右肾动脉栓塞
E. 右肾部分切除加放化疗

正确答案：A。根治性右肾切除

解析：中年男性患者，诊断为右肾下极恶性肿瘤，患者左肾功能正常，因此，首选的治疗方案为根治性右肾切除（A对），切除范围包括患肾、肾周脂肪及肾周筋膜、区域肿大淋巴结及髂血管分叉以上的输尿管。单纯肾切除（B错）、肾部分切除术（C错）虽可用于肾癌治疗，但疗效均不及根治性肾切除术，易导致肿瘤的复发。肾动脉栓塞（D错）用于手术不能切除的肾脏肿瘤、缓解患者症状的姑息性治疗或肾脏手术的术前处理。肾癌具有多药物耐药基因，对放疗及化疗（E错）不敏感。